口腔黏膜上皮由不全角化层所覆盖，钉突之间的上皮萎缩变薄，结缔组织中的血管增生且扩张充血，临床表现为
A. 白斑
B. 红斑
C. 扁平苔藓
D. 黏膜下纤维化
E. 天疱疮

正确答案：B。红斑

解析：红斑的表面上由不全角化层所覆盖，钉突之间的上皮萎缩变薄，结缔组织中的血管增生且扩张充血，因此临床上表现为红斑。掌握“口腔白斑、红斑病”知识点。